蛙的有髓神经纤维动作电位的持续时间约为2ms，从理论上讲它1s内所产生的动作电位的次数不可能超过多少次
A. 100
B. 200
C. 300
D. 400
E. 500

正确答案：E。500